下列有关新媒体的特点描述错误的是
A. 数字化与网络化
B. 超文本性与虚拟性
C. 高互动性
D. 经济性
E. 自主参与性

正确答案：D。经济性